糖类、蛋白质和脂肪的消化产物主要吸收部位是
A. 十二指肠
B. 十二指肠、空肠、回肠
C. 空肠、回肠
D. 回肠
E. 十二指肠和空肠

正确答案：E。十二指肠和空肠